能够引起口腔黏膜尖锐湿疣的病原体是
A. 梅毒螺旋体
B. 单纯疱疹病毒
C. 麻疹病毒
D. 水痘-带状疱疹病毒
E. 人类乳头瘤病毒

正确答案：E。人类乳头瘤病毒

解析：人类乳头瘤病毒可以引起口腔黏膜的尖锐湿疣。掌握“氟牙症、先天性梅毒牙与牙本质形成缺陷”知识点。